环境污染物危险度评价中的暴露评价可以估计出
A. 某化学物在环境介质中的浓度
B. 某化学物对机体产生危害的程度
C. 某化学物是否对机体产生危害
D. 危险物特征
E. 人群对某化学物暴露的强度、频率和持续时间

正确答案：E。人群对某化学物暴露的强度、频率和持续时间

解析：暴露评价又称接触评价，是有害物质危险度评价过程中不可缺少的一部分，其实质是研究人群与某种化学物的接触程度（E对）（P293）。危险度评价分为定性危险度评价和定量危险度评价，定量危险度评价是指该化学物对机体产生危害的程度（B错）（P293）。危害鉴定是危险度评价的第一步骤，属于定性评价阶段，其目的是确定在一定条件下，被评价的化学物是否对机体健康产生有害效应，这种效应是否具有该物质所固有的毒性特征和类型（C错）（P293）。危险物特征是毒理学研究的内容（D错）。